女性，56岁，外阴痒1周，白带乳块状，镜检发现真菌菌丝，合理的处理是
A. 阴道内放置咪康唑栓
B. 阴道内放置甲硝唑栓
C. 阴道内放置己烯雌酚栓
D. 外阴应用氢化可的松软膏
E. 外阴应用0.5%醋酸液清洗

正确答案：A。阴道内放置咪康唑栓

解析：该患者外阴痒，白带乳块状（外阴阴道假丝酵母菌病表现为外阴瘙痒，分泌物为白色稠厚呈凝乳或豆腐渣样），镜检发现真菌菌丝（在阴道分泌物中找到假丝酵母菌的芽生孢子或假菌丝即可确诊），故诊断为外阴阴道假丝酵母菌病。治疗主要采用局部短疗程抗真菌药，如阴道内放置咪康唑栓剂（A对）。阴道内放置甲硝唑栓（P248）（B错）主要用于细菌性阴道炎。阴道内放置己烯雌酚栓（P252）（C错）主要用于因雌激素水平降低引起的萎缩性阴道炎。外阴应用氢化可的松软膏（P242）（D错）用于外阴鳞状上皮增生，控制局部瘙痒。外阴应用0.5%醋酸液清洗（P104）（E错）用于治疗尖锐湿疣。